男性，50岁。胃窦癌行根治性胃大部切除术后2年，因上腹疼痛不适，进食后饱胀消瘦贫血入院，钡餐检查：胃空肠吻合口处有充盈缺损和狹窄。最可能的诊断是
A. 残胃癌
B. 胃癌复发
C. 碱液反流性胃炎
D. 吻合口消化性溃疡
E. 吻合口炎症水肿

正确答案：B。胃癌复发

解析：中年男性患者，2年前行胃窦癌根治术，现出现上腹部疼痛、进食后饱胀，消瘦、贫血，钡餐检查提示胃空肠吻合口处有充盈缺损和狭窄（提示吻合口处占位性病变），结合患者病史和钡餐检查，应考虑为胃癌复发（B对）。残胃癌（A错）指因良性疾病行胃大部切除术后5年以上，残胃出现的原发癌。碱液反流性胃炎（C错）主要表现为胸骨后或上腹部烧灼痛，呕吐含胆汁的物质，钡餐检查多无明显阳性发现。吻合口消化性溃疡（D错）钡餐检查可发现吻合口龛影。吻合口炎症水肿（E错）钡餐检查不会出现吻合口处充盈缺损和狭窄，行胃肠减压、抗炎治疗后多可缓解。